既能燥湿健脾，又祛风湿的药是
A. 苍术
B. 厚朴
C. 白术
D. 砂仁
E. 防风

正确答案：A。苍术

解析：本题考查的是苍术的功效。既能燥湿健脾，又祛风湿的药是苍术（A对）。苍术：【功效】燥湿健脾，祛风湿，发汗，明目。厚朴（B错）：【功效】燥湿，行气，消积，平喘。白术（C错）：【功效】补气健脾，燥湿利水，止汗，安胎。砂仁（D错）：【功效】化湿行气，温中止泻，安胎。防风（E错）：【功效】祛风解表，胜湿，止痛，解痉。